药品的日常管理应注意区分形似、音似药品，下列药物中属于抗肿瘤药的有
A. 氟胞嘧啶
B. 阿糖腺苷
C. 氟尿嘧啶
D. 阿糖胞苷
E. 氟哌啶醇

正确答案：C、D。氟尿嘧啶；阿糖胞苷

解析：本题考查抗肿瘤药。氟尿嘧啶（C对）、阿糖胞苷（D对）是抗肿瘤药物。氟胞嘧啶（A错）是抗真菌药物。阿糖腺苷（B错）是抗病毒药物。氟哌啶醇（E错）是抗精神分裂药物。